血液的正常运行依赖于
A. 心、肺、肾、肝
B. 肺、脾、肾
C. 心、肺、脾、肝
D. 脾、胃、肺、肾
E. 肺、小肠、肾、三焦

正确答案：C。心、肺、脾、肝

解析：本题考查的是血的运行。血液的正常运行依赖于心、肺、脾、肝（C对）。血的运行：血液循行于脉管之中，流布于全身，运行不息，以供给机体各脏腑组织器官的营养需要。血液的正常循行，依靠气的推动与固摄作用的协调平衡。心主血脉，心气的推动，是血液循行的基本动力。肺朝百脉，即全身的血液，汇聚于肺，依赖肺气作用合成宗气，助心行血，分布全身。肝主疏泄，调畅气机，气行则血行。而脾主统血和肝之藏血功能，依赖气的固摄作用，使血液运行于脉中而不逸于脉外。